下列土壤中含硒量相对较高的是
A. 棕褐土壤
B. 红黄土壤
C. 沙粒土壤
D. 黑粘土壤
E. 褐粘土壤

正确答案：B。红黄土壤

解析：本题考查含硒量相对较高的土壤。由于各地土壤中硒水平的差异，致使农作物中硒含量差别很大。一般来讲，红黄土壤（B对CDE错）生产的农作物硒含量相对较高；棕褐土壤（A错）生产的农作物硒含量则较低。